关于牙周膜血液供应来源的血管，不含有下列哪一项
A. 来自牙龈的血管
B. 来自上牙槽动脉的血管
C. 来自下牙槽动脉的血管
D. 来自上牙槽动脉在进入根尖孔前的分支
E. 来自上唇动脉进入根尖孔前的分支

正确答案：E。来自上唇动脉进入根尖孔前的分支

解析：牙周膜含有丰富的血管，主要有三个方面来源：①来自牙龈的血管；②来自上下牙槽动脉分支进入牙槽骨，再通过筛状板进入牙周膜；③来自上、下牙槽动脉在进入根尖孔前的分支。掌握“牙周膜”知识点。